下列有关牙本质过敏症的叙述中，不正确的是
A. 发作迅速、疼痛尖锐
B. 发作时间短暂
C. 是一种独立的疾病
D. 刺激除去后疼痛立即消失
E. 以机械刺激最为显著

正确答案：C。是一种独立的疾病

解析：牙本质过敏症又称过敏性牙本质或牙本质过敏，是牙齿在受到外界刺激，如温度（冷、热）、化学物质（酸、甜）以及机械作用（摩擦或咬硬物）等所引起的酸、软、痛症状，其特点为发作迅速、疼痛尖锐、时间短暂。导致牙本质过敏的外界刺激可以是生理范围的刺激。牙本质过敏症不是一种独立的疾病，而是多种牙体疾病共有的症状。掌握“牙本质敏感症”知识点。